银汞合金的主要金属相组成是
A. γ₁+γ₂
B. γ+γ₁
C. γ+γ₂
D. γ+γ₁+γ₂

正确答案：D。γ+γ₁+γ₂

解析：本题考查银汞合金的金属相组成。银汞合金是一种特殊的合金。它是由银合金粉与汞在室温下混合后形成的坚硬合金。银汞合金具有优良的性能，是一种使用历史悠久的牙齿充填修复材料。银汞合金中主要金相组成是γ+γ₁+γ₂（D对ABC错）。